《医方集解》所载二陈汤加减法指明，治疗寒痰宜加
A. 半夏、姜汁
B. 石膏、青黛
C. 苍术、白术
D. 瓜蒌、杏仁
E. 香附、枳壳

正确答案：A。半夏、姜汁

解析：二陈汤方含半夏、橘红、茯苓、炙甘草、乌梅，以燥湿化痰，理气和中，是治疗痰证的基础方。故《医方集解》指出：“治痰通用二陈。风痰加南星、白附、皂角、竹沥；寒痰加半夏、姜汁（A对）；火痰加石膏、青黛；湿痰加苍术、白术；燥痰加栝蒌、杏仁；食痰加山楂、麦芽、神曲；老痰加枳实、海石、芒硝；气痰加香附、枳壳；胁痰在皮里膜外加白芥子；四肢痰加竹沥”。